下列能体现疾病社会性的是
A. 病因的社会性
B. 疾病防治策略的社会性
C. 疾病结果的社会性
D. 以上都包括

正确答案：D。以上都包括

解析：本题考查疾病社会性的体现。疾病的社会性体现在病因的社会性，疾病防治策略的社会性和疾病结果的社会性（D对ABC错）。